治水肿日久脾肾阳虚者，用利水渗湿药必需配用的药物是
A. 滋补脾肾药
B. 益脾滋肾药
C. 健脾利水药
D. 温补脾肾药
E. 温肾壮阳药

正确答案：D。温补脾肾药

解析：本题考查的是利水渗湿药的临床应用。治水肿日久脾肾阳虚者，用利水渗湿药必需配用的药物是温补脾肾药（D对）。凡以通利水道、渗湿利水为主要功效的药物，称为利水渗湿药。本类药主要适用于小便不利、水肿、淋浊、黄疸、水泻、带下、湿疮、痰饮等水湿内盛之病证。临床应用时，水肿骤起有表证者，配宣肺发汗药；水肿日久属脾肾阳虚者，配温补脾肾药；湿热交蒸者，配清热药；热伤血络而尿血者，配凉血止血药。